神在全身皆有表现，但却突出地表现于
A. 语言
B. 动态
C. 目光
D. 表情
E. 应答反应

正确答案：C。目光

解析：《医原·望病须察神气论》云“人之神气，栖于二目”，说明两目最易传神。目为五脏六腑精气汇聚之地，目系通于脑，其活动直接受心神支配，所以观察两目对于望神显得尤为重要（C对）。